在体内发生氧化、还原、水解等反应使得药物极性增大，该代谢类型属于
A. 弱代谢作用
B. Ⅰ相代谢反应
C. 酶抑制作用
D. 酶诱导作用
E. Ⅱ相代谢反应

正确答案：B。Ⅰ相代谢反应

解析：本题考查Ⅰ相代谢反应。在体内发生氧化、还原、水解等反应使得药物极性增大，该代谢类型属于Ⅰ相代谢反应（B对）。酶抑制作用（C错）是指通过抑制肝药酶活性，减慢其他药物的代谢速率。某些化学物质能提高肝药酶活性，增加自身或其他药物的代射速率，此现象称酶诱导。具有酶诱导作用的物质叫酶诱导剂。如苯巴比妥、苯妥英钠等有肝药酶诱导作用（D错。Ⅱ相代谢反应（E错）包括与葡萄糖醛酸的结合反应、与硫酸的结合反应、与氨基酸的结合反应、与谷胱甘肽的结合反应、乙酰化结合反应、甲基化结合反应。